男，69岁。咳嗽、咳痰5个月，呈刺激性咳嗽，时有痰中带血，不伴发热、盗汗，吸烟史30余年，胸部X线示右肺门处团块状影。该患者最可能的诊断是
A. 支气管扩张
B. 肺结核
C. 急性支气管炎
D. 肺脓肿
E. 肺癌

正确答案：E。肺癌

解析：患者为老年男性（肺癌的好发人群），吸烟30余年（肺癌的重要病因之一），无肺部疾病病史，刺激性咳嗽1个月，痰中带血1周（肺癌表现），根据患者既往史及临床表现，最可能的诊断是肺癌（E对）。支气管扩张（P37）（A错）主要表现为反复的咳嗽、咳痰或咳脓痰。肺结核（P65）（B错）多有典型的结核杆菌感染表现，身体乏力、消瘦、午后盗汗低热等。急性支气管炎（P17）（C错）咳嗽、咳痰，两肺闻及散在干、湿性啰音。肺脓肿（P58）（D错）常见症状为急性起病，畏寒，高热，体温达39～40℃，伴有咳嗽，咳黏液痰或黏液脓性痰，此外还有全身中毒症状。